污水一级处理主要是为了除去
A. BOD
B. 悬浮固体
C. 总固体
D. 氮肥等营养物质
E. 细菌

正确答案：B。悬浮固体

解析：本题考查污水一级处理。污水的一级处理也称物理法。物理处理是指通过机械阻留、沉淀和膜过滤等物理措施实现污染物浓度降低的处理技术。机械阻留包括格栅、筛网等，废水流经其孔隙时将较大的悬浮物和漂浮物阻留下来。沉淀则是废水中悬浮物通过重力沉降作用，沉入池底污泥斗而被去除，常用的沉淀池有平流式、竖流式和斜板式沉淀池等形式。因此污水一级处理主要是为了除去悬浮固体（B对ACDE错）。